将一定量的药材细粉或药材提取物加适宜辅料制成均匀的粉末或颗粒，充填于空心胶囊中制成的药剂，称为
A. 滴丸
B. 胶丸
C. 硬胶囊剂
D. 浓缩丸
E. 乳剂

正确答案：C。硬胶囊剂